可作为氨基糖苷类的替代品，与其合用可加强对铜绿假单胞菌和肠杆菌作用的药物是
A. 阿莫西林
B. 亚胺培南
C. 氨曲南
D. 克拉维酸
E. 替莫西林

正确答案：C。氨曲南

解析：本题考查氨曲南。氨曲南（C对）由于其抗菌谱与氨基糖苷类似而无氨基糖苷类的肾毒性，可作为氨基糖苷类的替代品，与其合用可加强对铜绿假单胞菌和肠杆菌作用。阿莫西林（A错）为广谱青霉素类药。亚胺培南（B错）为碳青霉烯类药物中的代表药。克拉维酸（D错）为β-内酰胺酶抑制剂，可与β-内酰胺类抗生素联合应用，增强药效。替莫西林（E错）为耐β-内酰胺酶的半合成青霉素类抗生素。